某男，19岁。面部粟疹累累，疼痛，色红部分有脓疱，口渴，大便秘结，小便短赤，舌质红，苔薄黄，脉弦滑。应选用的中成药是
A. 黄连上清丸
B. 牛黄解毒丸
C. 当归苦参丸
D. 牛黄清心丸
E. 防风通圣丸

正确答案：A。黄连上清丸

解析：本题考查的是肺经风热证的辨证论治。面部粟疹累累，疼痛，色红部分有脓疱，口渴，大便秘结，小便短赤，舌质红，苔薄黄，脉弦滑。应选用的中成药是黄连上清丸（A对）。痤疮肺经风热证【症状】面部粟疹累累，色红，疼痛，或有脓疱，伴口干口渴、大便秘结，小便短赤；舌红苔薄黄，脉弦滑。【治法】疏风清肺。【中成药应用】黄连上清丸。牛黄解毒丸（B错），具有清热解毒之功效。用于火热内盛，咽喉肿痛，牙龈肿痛，口舌生疮，目赤肿痛。粉刺痰湿瘀滞证【症状】皮疹颜色暗红，以结节、脓肿、囊肿、瘢痕为主，或见窦道，经久难愈；伴纳呆腹胀。舌质暗红或有瘀斑，苔黄腻，脉弦滑。【中成药应用】当归苦参丸（C错）。牛黄清心丸（D错），具有清热解毒，开窍安神之功效。主治温邪内陷，热入心包，痰涎壅塞，烦热神昏，谵语抽搐。瘾疹胃肠湿热证【症状】风团大片色红，瘙痒剧烈；发疹的同时伴脘腹疼痛，恶心呕吐，神疲纳呆，大便秘结或泄泻。舌质红，苔薄白或黄，脉弦滑数。【中成药应用】防风通圣丸（E错）。